女，39岁。因胆结石行胆囊切除术后1天。静息能量消耗（REE）比正常约增加
A. 50%
B. 10%
C. 30%
D. 5%
E. 20%

正确答案：B。10%

解析：外科感染、手术创伤等应激情况下，静息能量消耗增加。一般而言，手术约增加10%（B对），创伤、感染增加约20%-30%。